口腔流行病学不是
A. 流行病学的一个分支
B. 研究口腔疾病的人群分布规律
C. 口腔预防医学的基础
D. 口腔分子生物学的基础
E. 研究影响疾病分布的相关因素

正确答案：D。口腔分子生物学的基础

解析：本题考查口腔流行病学。口腔分子生物学的基础是口腔细胞生物学（D错，为本题的正确答案），不是口腔流行病学。口腔流行病学是流行病学的一个分支（A对），是口腔预防医学的基础（C对），用于研究口腔疾病的人群分布规律（B对）及影响疾病分布的相关因素（E对）。